营血的作用重在
A. 润泽肌肤
B. 营养周身
C. 温煦内脏
D. 补益脑髓
E. 以上都不是

正确答案：B。营养周身

解析：营气的生理功能有化生血液和营养全身（B对）。营气经肺注入脉中，组成血液有效成分之一，同时流注全身，为五脏六腑，全身经脉提供营养物质。津的质地较清晰，布散于体表能滋润皮毛肌肉（A错）。温煦内脏（C错），为人体之气均有的功能。补益脑髓（D错）是液的作用。